营养性贫血脾肾阳虚证的治疗方剂为
A. 参苓白术散加减或异功散加味
B. 归脾汤加减
C. 左归丸加减
D. 右归丸加减
E. 四物汤加减

正确答案：D。右归丸加减

解析：营养性贫血脾肾阳虚证是由于久病耗伤，精血大虚，阴损及阳所致，故治疗时应温补脾肾，益精养血，首选右归丸（D对）。归脾汤（B错）其功用为益气补血，健脾养心，适用于营养性缺铁性贫血之心脾两虚证。参苓白术散加减或异功散加味（A错）适用于营养性缺铁性贫血之脾胃虚弱证。左归丸（C错）其功用为滋阴补肾，填精益髓，适用于营养性缺铁性贫血之肝肾阴虚证。四物汤（E错）其功用为补血调血，适用于营血虚滞证。